有排卵性功血的子宫内膜变化是
A. 增生型子宫内膜
B. 分泌型子宫内膜
C. 萎缩型子宫内膜
D. 子宫内膜腺囊型增生过长
E. 子宫内膜腺瘤型增生过长

正确答案：B。分泌型子宫内膜

解析：排卵性功血分为月经过多和月经周期间出血，月经过多时子宫内膜形态一般表现为分泌期内膜，而月经周期间出血又分为黄体功能异常和围排卵期出血。其中黄体功能异常可分为黄体功能不全和子宫内膜不规则脱落，黄体功能不全时子宫内膜形态一般表现为分泌期内膜、腺体分泌不良，间质水肿不明显或腺体与间质发育不同步；子宫内膜不规则脱落常表现为混合型子宫内膜，即残留的分泌期内膜与出血坏死组织及新增生的内膜混合共存。故有排卵性功血的子宫内膜变化是分泌型子宫内膜（B对）。（P345）增生型子宫内膜（A错）、萎缩型子宫内膜（C错）、子宫内膜腺囊型增生过长（D错）即单纯型增生、子宫内膜腺瘤型增生过长（E错）即复杂型增生都属于无排卵性功血的子宫内膜改变。